下列制剂，不属于主动免疫的是
A. 抗毒素
B. 灭活死疫苗
C. 菌苗
D. 减毒活疫苗
E. 类毒素

正确答案：A。抗毒素

解析：接种疫苗（B对）、菌苗（C对）、类毒素（E对）等之后可使机体产生对抗病毒、细菌、毒素等的特异性主动免疫，注射抗毒素、丙种球蛋白或高滴度免疫球蛋白，可使机体获得特异性被动免疫（A错，为本题正确答案）。减毒活疫苗是由无毒或弱毒的病原微生物制成的，无毒性和致病性，但保留了免疫原性（D对）及在体内的增值活性。